男，58岁。反复腹胀、尿少3年，加重伴双下肢水肿、腹围明显增加2周。乙型肝炎病史15年。腹部查体中不可能出现的体征是
A. 腹式呼吸减弱
B. 尺压试验阳性
C. 全腹膨隆
D. 移动性浊音阳性
E. 液波震颤阳性

正确答案：B。尺压试验阳性

解析：中年男性患者，乙型肝炎病史15年（肝硬化的高危因素），反复腹胀、尿少3年，加重伴双下肢水肿、腹围明显增加2周（肝硬化失代偿期的表现）。综合患者的病史、临床表现，考虑为肝炎后肝硬化伴腹水。大量腹水使横膈抬高和运动受限，腹式呼吸减弱（A对）；在体格检查时，可表现为全腹膨隆（C对）、移动性浊音阳性（腹水在1000ml以上时出现）（D对）、液波震颤阳性（腹水在3000～4000ml以上时出现）（E对）。尺压试验主要是用于区分卵巢囊肿和腹水的检查方法。患者仰卧位，用一硬尺横置于腹壁上，医师两手将尺压下，如为卵巢囊肿，则主动脉腹部的搏动可经囊肿传到硬尺，使尺发生节奏性跳动，为尺压试验阳性；如为腹水，则硬尺无搏动，尺压试验阴性（B错，为本题正确答案）。